慢性腹泻患者大便培养伤寒杆菌阳性，应考虑的诊断是
A. 伤寒带菌者
B. 伤寒确诊病例
C. 骨髓炎
D. 伤寒临床诊断病例
E. 慢性菌痢

正确答案：A。伤寒带菌者

解析：少数伤寒患者病后可成为长期带菌者，持续带菌超过3个月者称为慢性带菌者。结合题干“慢性”及“伤寒杆菌阳性”考虑为伤寒带菌者（A对）。